容易导致出血性膀胱炎的药物是
A. 奥沙利铂
B. 异环磷酰胺
C. 伊立替康
D. 丝裂霉素
E. 氟尿嘧啶

正确答案：B。异环磷酰胺

解析：本题考查异环磷酰胺。环磷酰胺和异环磷酰胺（B对）可引起出血性膀胱炎，表现为尿频、排尿困难等尿道刺激症状，继而出现血尿，异环磷酰胺引起出血性膀胱炎的风险更高；因此，治疗时需同步给予美司钠，预防剂量通常为环磷酰胺/异环磷酰胺剂量的20%，分别在给药后0小时、4小时、8小时静脉滴注美司钠。奥沙利铂（A错）具有神经毒性。伊立替康（C错）可引起腹泻。丝裂霉素（D错）可引起急性肾小管坏死。氟尿嘧啶（E错）可致心脏毒性。